患者，女，36岁，诊断弥漫性大B细胞淋巴瘤，拟行“利妥昔单抗+环磷酰胺+多柔比星+长春新碱+泼尼松（R-CHOP）”方案化疗，每3周一次。该化疗称为
A. 研究性化疗
B. 新辅助化疗
C. 根治性化疗
D. 辅助化疗
E. 姑息性化疗

正确答案：C。根治性化疗

解析：本题考查常见的化疗方式。根治性化疗（C对）：血液、淋巴和生殖系统肿瘤属于对化疗高度敏感的肿瘤类型，部分经化疗药物治疗可治愈。因此，方案中的药物尽量用至人体能耐受的最大剂量，尽可能缩短间隔时间，从而发挥对肿瘤的最大杀伤力。